免疫球蛋白的基本结构是
A. 由四条相同的重链组成
B. 由四条相同的轻链组成
C. 由二硫键相连的四条肽链组成
D. 由二硫键相连的二条肽链组成
E. 由J键连接的五条肽链组成

正确答案：C。由二硫键相连的四条肽链组成

解析：免疫球蛋白的基本结构：Ig单体由两条相同的重链和两条相同的轻链由链间二硫键连接组成。掌握“免疫球蛋白基本概念及结构”知识点。